感冒退热颗粒除疏风解表外，还可
A. 清热解毒
B. 疏风散寒
C. 宣肺止咳
D. 解热止痛
E. 益气固表

正确答案：A。清热解毒

解析：本题考查感冒退热颗粒的功能。感冒退热颗粒除疏风解表外，还可清热解毒（A对）。感冒退热颗粒【功能】疏风解表，清热解毒。感冒清热颗粒（口服液、胶囊）【功能】疏风散寒（B错），解表清热。桑菊感冒片（颗粒、丸、合剂）【功能】疏风清热，宣肺止咳（C错）。正柴胡饮颗粒【功能】发散风寒，解热止痛（D错）。玉屏风胶囊（颗粒、口服液）【功能】益气，固表（E错），止汗。